一些做临床科研工作的医生未征求病人的同意，只与病人的主管大夫打声招呼，便以某种理由或在正常检查时顺便多取些血液或骨髓穿刺液等。从医学伦理学上分析，下列哪种说法正确
A. 若告知，患者会产生不必要的心理负担，不利于原来疾病的治疗，所以不告知在道德上可通过辩护
B. 若告知，病人多数不会同意，科研没有保障，所以不告知在道德上可通过辩护
C. 临床科研的动机是善良的，即便未经过知情同意，在道德上也无可指责
D. 无论科研的动机好坏，只要未经过患者的知情同意，任何涉及人体的生物医学研究在道德上都不能通过辩护
E. 病人有义务支持医学科学的发展，故医生有权利这样做

正确答案：D。无论科研的动机好坏，只要未经过患者的知情同意，任何涉及人体的生物医学研究在道德上都不能通过辩护